男，65岁。间断腹胀、上腹隐痛25年。胃镜检查提示：胃体黏膜变薄，血管透见，皱襞稀疏。患者可能缺乏的维生素是
A. 维生素B₄
B. 维生素C
C. 维生素B₁₂
D. 维生素B₂
E. 维生素D

正确答案：C。维生素B₁₂

解析：老年男性患者，有腹胀、上腹隐痛表现，胃镜检查提示：胃体黏膜变薄，血管透见，皱襞稀疏（慢性萎缩性胃炎的典型胃镜表现），可诊断为慢性萎缩性胃炎。慢性萎缩性胃炎分为A型胃炎（自身免疫性胃炎）和B型胃炎，A型胃炎累及部位为胃体、胃底，B型胃炎累及部位为胃窦，该患者病变主要集中在胃体，所以可诊断为A型胃炎。A型慢性患者，血中抗壁细胞抗体和内因子抗体阳性，内因子缺乏，内因子与维生素B₁₂的吸收有关，所以患者最可能缺乏的维生素是维生素B₁₂（C对）。维生素B₄（A错）是腺嘌呤的旧称，可以在体内通过多种途径合成，一般不会缺乏。维生素C（B错）存在于新鲜的蔬菜和水果中，通常是因未食用新鲜蔬果导致维生素C缺乏，与慢性胃炎无关。维生素B₂（D错）又名核黄素，多因食物烹调不合理（食用粗粮过少）引起。维生素D（E错）缺乏多由摄入过少或晒太阳较少引起。